中医认为急性左心衰属于下列哪项
A. 心阴虚衰为本
B. 心阳虚衰为本
C. 心气虚衰为本
D. 心血虚衰为本
E. 以上均不是

正确答案：B。心阳虚衰为本

解析：急性左心衰的临床表现为劳力性呼吸困难，端坐呼吸等，以肺淤血及心排血量降低致组织器官低灌注等临床表现为主，心气虚久，累及心阳，致心阳受损，心阳虚的证候日渐显著（B对）。气阴虚表现为心悸气短，身重乏力，心烦不寐，口咽干燥，小便短赤，甚则五心烦热，潮热盗汗，眩晕耳鸣，肢肿形瘦，唇甲稍暗，舌质暗红，少苔或无苔，脉细数或促或结（AB错）。心血虚衰表现为心悸怔忡，胸闷气短，甚则喘咳，动则尤甚，神疲乏力，面白或暗淡，自汗，脉虚涩（D错）。